血清丙氨酸氨基转移酶（ALT）的正常值参考范围是
A. ＜40U/L
B. 速率法＜30U/L
C. 速率法≤40U/L
D. 速率法 成人＜40U/L
E. 速率法 成人≤30U/L

正确答案：D。速率法 成人＜40U/L

解析：本题考查肝功能检查。血清丙氨酸氨基转移酶（ALT）的正常值参考范围是：成人＜40U/L（D对）。